某3岁男童，未曾服用过脊髓灰质炎疫苗，在9月份来院就医，家人代诉发热、多汗、烦躁、头痛、呕吐、下肢肌肉疼痛，体检发现下肢出现不对称的肢体迟缓性瘫痪，该患儿的诊断应首先考虑
A. 病毒性脑炎
B. 临床上可拟诊断为脊髓灰质炎
C. 临床上可诊断为脊髓灰质炎
D. 已可确诊为脊髓灰质炎
E. 以上都不对

正确答案：C。临床上可诊断为脊髓灰质炎